属于手肌的是
A. 指深屈肌
B. 指浅屈肌
C. 小指展肌
D. 指伸肌
E. 小指伸肌

正确答案：C。小指展肌

解析：小指展肌（C对）属于手肌，指深屈肌（A错）、指浅屈肌（B错）、指伸肌（D错）、小指伸肌（E错）不属于手肌，而是前臂肌。